环状染色体是
A. 染色体长臂两端连接形成环状
B. 染色体短臂两端连接形成环状
C. 染色体两臂断裂重新形成环状
D. 以上都对

正确答案：C。染色体两臂断裂重新形成环状

解析：本题考查环状染色体。环状染色体是染色体两臂各发生一次断裂，重接形成环状结构（C对ABD错）。